与月经周期中分泌期体温升高相关的因素是
A. 孕酮
B. 雌三醇
C. 雌二醇
D. 雄烯二酮
E. 雌酮

正确答案：A。孕酮

解析：孕酮由黄体细胞分泌，是孕激素中的主要激素，它具有提高体温并使血管和消化道平滑肌松弛的作用（A对）。雌激素的合成有卵泡膜细胞与颗粒细胞在FSH和LH共同作用下完成：LH与卵泡膜细胞LH受体结合后可使胆固醇转化为睾酮和雄烯二酮（D错），两者进入颗粒细胞后，当FSH与颗粒细胞上FSH受体结合激活芳香化酶，在该酶作用下分别转化为雌二醇（C错）和雌酮（E错），后二者与雌三醇（B错）均为天然雌激素，在代谢途径中，雌二醇主要在肝脏转换为雌酮、雌三醇等经肾脏排出。